关于非甾体抗炎药选药原则的说法，正确的是
A. 解除平滑肌痉挛性疼痛可首选非甾体抗炎药
B. 非甾体抗炎药可替代抗感染治疗
C. 治疗未明原因的发热可立即应用非甾体抗炎药
D. 非甾体抗炎药可用于治疗骨关节炎
E. 非甾体抗炎药可用于创伤疼痛

正确答案：D。非甾体抗炎药可用于治疗骨关节炎

解析：本题考查非甾体抗炎药的选药原则。非甾体抗炎药可使前列腺素的合成减少，改善炎症部位的肿痛症状，代表药物对乙酰氨基酚为缓解轻中度骨性关节炎疼痛（D对）的首选药；内脏平滑肌痉挛（A错）、对创伤性剧痛（E错）均应使用中枢神经系统镇痛药；抗感染治疗（B错）应选抗菌药；对于未明原因的发热，应慎重使用非甾体抗炎药（C错）。